《红楼梦》中的林黛玉，其动作稳定缓慢，观察事物细致入微，敏感多疑，孤独多虑，情感体验深刻且持久。林黛玉的气质类型属于
A. 多血质
B. 粘液质
C. 胆汁质
D. 抑郁质
E. 兴奋质

正确答案：D。抑郁质

解析：抑郁质的外部表现：敏感胆怯，情感体验深，稳定而不易表露，动作缓慢，有时近于呆板，易伤感，孤僻，善观察细小事。掌握“人格”知识点。